处方中“餐前给药”的外文缩写是
A. Ac
B. pc
C. po
D. qn
E. prn

正确答案：A。Ac

解析：本题考查处方中常见的外文缩写及其含义。医师在书写处方正文时会采用拉丁文缩写或者英文缩写表示，其中Ac（A对）缩写含义为餐前（服）；pc.（B错）缩写含义为餐后；po.（C错）缩写含义为口服；qn.（D错）缩写含义为每晚；prn（E错）缩写含义为必要时。